血K⁺浓度升高时，分泌增加的激素是
A. 心房钠尿肽
B. 血管紧张素Ⅱ
C. 肾素
D. 醛固酮
E. 抗利尿激素

正确答案：D。醛固酮